检测IgG含量常用的简单方法是
A. 间接血凝
B. 单向免疫扩散
C. ELISA
D. 对流电泳
E. 火箭电泳

正确答案：C。ELISA